《素问·阴阳应象大论》指出对“精不足者”，宜采取的治则是
A. 掣引之
B. 引而竭之
C. 温之以气
D. 补之以味
E. 阴阳双补

正确答案：D。补之以味

解析：“精不足者，补之以味”（D对）意为凡精不足者为阴精亏虚，治疗当用味厚滋养阴精之品以滋肾填精。“血实宜决之，气虚宜掣引之”（A错）。“其在下者，引而竭之”（B错）。“形不足者，温之以气”（C错）。